小于1岁小孩的用品中不得检出的物质是
A. 甲醛
B. 铅
C. 汞
D. 铬
E. 砷

正确答案：A。甲醛

解析：本题考查小于1岁小孩的用品中不得检出的物质。小于1岁小孩的用品中不得检出的物质是甲醛（A对BCDE错）。